男，45岁。发热3天，少尿1天，于12月15日入院。查体：BP60/30mmHg，神志清，球结膜充血、水肿，双腋下有出血点，实验室检查：WBC25×10⁹/L，plt50×10⁹/L，尿蛋白（+++）。病原治疗首选药物是
A. 四环素
B. 环丙沙星
C. 利巴韦林
D. 金刚烷胺
E. 青霉素

正确答案：C。利巴韦林

解析：45岁男性，发热3天（肾综合征出血热发热期全身中毒症状），少尿1天（肾综合征出血热少尿期），于12月15日入院（肾综合征出血热高发季节）；查体：BP60/30mmHg（血压低），神志清，球结膜充血、水肿，双腋下有出血点（毛细血管损害征），实验室检查：WBC25×10⁹/L（成人正常参考值4～10×10⁹/L），plt50×10⁹/L（100～300×10⁹/L），尿蛋白（+++）（肾损害），根据患者的临床表现和实验室结果，最可能的诊断是肾综合征出血热，本病治疗以综合治疗为主，早期应用抗病毒治疗，中晚期则针对病理生理进行对症治疗，病原治疗首选药为抗病毒药物利巴韦林（C对），能抑制病毒，减轻病情和缩短病程。金刚烷胺（D错）可用于抗病毒治疗，但多用于预防或治疗亚洲甲-Ⅱ型流感病毒所引起的呼吸道感染。肾综合征出血热汉坦病毒感染，四环素（A错）、环丙沙星（B错）、青霉素（E错）都是抗细菌药物。